月经提前，心悸怔忡，健忘不眠，食少体倦，面色萎黄，舌淡苔薄白，脉细弱者，治疗应选用
A. 牡蛎散
B. 归脾汤
C. 补中益气汤
D. 四物汤
E. 黄土汤

正确答案：B。归脾汤

解析：心主血而藏神，脾主思而藏意，心脾气血两虚则神无所主，意无所藏，故见心悸怔忡、健忘失眠；脾胃为后天之本，气血生化之源，故脾虚则化源不足，气血衰少，而见食少体倦、面色萎黄、舌质淡、脉弱。月经提前，是因脾虚而不能统血之故。故治疗宜用健脾养心与益气补血兼施的归脾汤（B对）。牡蛎散（A错）的功用为敛阴止汗，益气固表，主治自汗、盗汗证。补中益气汤（C错）的功用为补中益气，升阳举陷，主治脾胃气虚证；气虚下陷证；气虚发热证。四物汤（D错）的功用为补血和血，主治营血虚滞证。黄土汤（E错）的功用为温阳健脾，养血止血，主治脾阳不足，脾不统血证。